直腿抬高试验阳性表明
A. Schmorl结节
B. 马尾神经损伤
C. 慢性腰肌劳损
D. 腰3～4椎间盘膨出
E. 腰4～5或腰5～骶1椎间盘突出症

正确答案：E。腰4～5或腰5～骶1椎间盘突出症

解析：直腿抬高试验阳性提示有坐骨神经受累，坐骨神经源自腰4、5骶1～3神经，腰4-5、腰5-骶1椎间盘突出症可分别压迫腰5、骶1神经根，使得神经根滑动度减少或消失，患肢抬高在60°以内即可出现坐骨神经痛，故直腿抬高试验阳性表明有腰4～5或腰5～骶1椎间盘突出症（E对）。Schmorl结节（P732）（A错）指髓核经上下软骨板的发育性或后天性裂隙突入椎体松质骨内，临床上无神经受压症状，所以直腿抬高试验阴性。马尾神经损伤（P732）（B错）常表现为大小便功能障碍，鞍区感觉异常，直腿抬高试验阴性。慢性腰肌劳损（P734）（C错）主要指腰骶部肌肉、筋膜、韧带等软组织的慢性损伤，导致局部无菌性炎，引起腰骶部弥漫性疼痛，无坐骨神经受压表现，所以直腿抬高试验阴性。依据七版黄家驷外科学（P3136），腰3-4椎间盘膨出一般不引起神经根受压，因此直腿抬高试验为阴性（D错）。